当归的主产地是
A. 甘肃
B. 河南
C. 四川
D. 云南
E. 吉林

正确答案：A。甘肃

解析：本题考查的是当归的产地。当归的主产地是甘肃（A对）。当归：【产地】主产于甘肃岷县、武都、漳县、成县、文县等地；湖北、云南、四川等省也产。主为栽培。怀药：主产地河南（B错）。如著名的“四大怀药”——地黄、牛膝、山药、菊花；以及天花粉、瓜蒌、白芷、辛夷、红花、金银花、山茱萸等。川药：主产地四川（C错）、西藏等。如川贝母、川芎、黄连、川乌、附子、麦冬、丹参、干姜、白芷、天麻、川牛膝、川楝子、川楝皮、川续断、花椒、黄柏、厚朴、金钱草、五倍子、冬虫夏草、麝香等。云药：主产地云南（D错）。如三七、木香、重楼、茯苓、萝芙木、诃子、草果、马钱子、儿茶等。关药：主产地山海关以北、东北三省（E错）及内蒙古东部。如人参、鹿茸、细辛、辽五味子、防风、关黄柏、龙胆、平贝母、刺五加、升麻、桔梗、哈蟆油、甘草、麻黄、黄芪、赤芍、苍术等。